血栓闭塞性脉管炎早期的主要临床症状是
A. 皮肤温度降低
B. 下肢麻木感
C. 间歇性跛行
D. 足背动脉搏动消失
E. 血管杂音

正确答案：B。下肢麻木感

解析：血栓闭栓性脉管炎是主要累及四肢远端中、小动静脉的慢性、节段性、周期性发作的血管炎性病变，又称Buerger病，简称脉管炎，好发于男性青壮年，与吸烟密切相关。其临床表现分为三期：局部缺血期、营养障碍期和组织坏死期。早期主要表现为患肢苍白、发凉、酸胀乏力及麻木（B对）、刺痛、烧灼感等感觉异常，接着出现间歇性跛行（C错），间跛起始于足背或足弓部，随病情进展出现腓肠肌疼痛，体检表现为患肢远端的动脉搏动减弱或消失（D错），此为局部缺血期；随着间跛距离缩短，出现静息状态下持续患肢疼痛，同时患肢皮温明显下降（A错）、苍白、潮红、发绀，并伴营养障碍，为营养障碍期；病情晚期，出现患肢肢端发黑、干瘪、溃疡或坏疽，为组织坏死期。血栓闭塞性脉管炎一般无血管杂音（E错）。